可引起恶心，呕吐，腹泻，面色苍白，瞳孔极度缩小，血压下降，昏睡，呼吸浅而不规则等不良反应的饮片是
A. 罂粟壳
B. 朱砂
C. 苦杏仁
D. 蜈蚣
E. 苍耳子

正确答案：A。罂粟壳

解析：本题考查的是中药饮片的不良反应。可引起恶心，呕吐，腹泻，面色苍白，瞳孔极度缩小，血压下降，昏睡，呼吸浅而不规则等不良反应的饮片是罂粟壳（A对）。罂粟壳的不良反应表现：罂粟壳中含有的主要成分是吗啡、可待因、罂粟碱等，罂粟壳中毒与其所含的主要成分吗啡有关。其临床表现为昏睡或昏迷，抽搐，呼吸浅表而不规则，恶心、呕吐、腹泻，面色苍白，发绀、瞳孔极度缩小呈针尖样，血压下降等。目前文献报道的病例报告中，罂粟碱中毒均体现在婴幼儿中，可能因为婴儿中枢神经系统、肝、肾、酶系统等发育未成熟，对中药较敏感，易引起中毒。含朱砂（B错）、轻粉、红粉的中成药的中毒表现：1.消化系统表现为恶心呕吐、腹痛腹泻、口中有金属味、流涎、口腔黏膜充血、牙龈肿胀溃烂等。2.泌尿系统表现为少尿、蛋白尿，严重者可发生急性肾功能衰竭。3.神经系统及精神方面症状。苦杏仁（C错）的不良反应表现：苦杏仁的主要成分苦杏仁苷是其有效成分也是中毒成分，误服过量苦杏仁可发生氢氰酸中毒，使延髓等生命中枢先抑制后麻痹，并抑制细胞色素氧化酶的活性而引起组织窒息。临床表现为眩晕、心悸、恶心、呕吐等中毒反应，重者出现昏迷、惊厥、瞳孔散大、对光反应消失，最后因呼吸麻痹而死亡。蜈蚣（D错）的不良反应表现：①消化道症状：恶心、呕吐，腹痛、腹泻，十二指肠溃疡，黄疸、急性肝损害等。②循环系统：胸闷、气短，心律失常，血压下降等。③泌尿系统：急性肾功能损害，尿量减少等。④血液系统：溶血性贫血，酱油尿、黑便等。⑤神经系统：抽搐、面神经损害等。⑥过敏反应：过敏性皮疹、口唇肿胀、鼻黏性分泌物大量流出、呼吸困难等，严重者可致过敏性休克。苍耳子（E错）的不良反应表现：①消化系统：恶心、呕吐，腹痛、腹泻，重者可见黄疸、肝肿大、消化道出血等。②神经系统：头痛、头晕等。③循环系统：胸闷、心慌气短、血压下降、心律失常、房室传导阻滞等。④呼吸系统：呼吸困难、呼吸节律不整、肺水肿等。⑤泌尿系统：水肿、少尿、尿闭、血尿、尿失禁、肾功能异常、急性肾功能衰竭等。⑥其他：见于报道的还有血小板减少性紫癜、神经性水肿、声哑、喉头水肿、喉梗塞等。